不易受镰刀菌污染的粮食是
A. 小麦
B. 玉米
C. 大米
D. 黄豆
E. 小米

正确答案：C。大米

解析：本题考查不易受镰刀菌污染的粮食。大骨节病病区粮食易被镰刀菌污染，可产生某些对机体有害的毒素，例如T-2毒素。检测结果显示，大米（C对DE错）不易受镰刀菌污染，而小麦（A错）、玉米（B错）最容易受镰刀菌污染。